鼓室壁叙述错误的是
A. 下壁亦称颈静脉壁
B. 上壁又称盖壁
C. 内侧壁乳突壁
D. 外侧壁鼓膜壁
E. 前壁颈动脉壁

正确答案：C。内侧壁乳突壁

解析：上壁又称盖壁（B对）。下壁亦称颈静脉壁（A对）。鼓室外侧壁大部分由鼓膜构成，故又名鼓膜壁（D对）。前壁也称颈动脉壁（E对），即颈动脉管的后壁。内侧壁又称迷路壁（C错，为本题正确答案），与内耳相隔。